采用低温养护法贮存饮片，最适宜的温度是
A. 低于0℃
B. 低于2℃
C. 2℃～10℃
D. 11℃～15℃
E. 16℃～20℃

正确答案：C。2℃～10℃

解析：本题考查的是中药养护的低温养护法。采用低温养护法贮存饮片，最适宜的温度是2℃～10℃（C对）。低温养护法：一般蛀虫在环境温度8～10℃停止活动，在-8～-4℃进入冬眠状态，温度低于-4℃经过一定时间，可以使害虫致死。采用低温（2～10℃）贮存饮片，就可以有效防止不宜烘、晾中药的生虫、发霉、变色等变质现象发生。梅雨季节来临时，可将饮片贮藏于冷藏库中，温度以2～10℃为宜，不仅能防霉、防虫、防变色、走油，而且不影响药材品质。由于此法需要一定的设备，费用较大，故主要用于贵重药材，特别是容易霉蛀的药材以及无其他较好办法保管的药材。例如哈蟆油、银耳、人参、菊花、山药、枸杞子、陈皮等也常用此法。冷藏最好在梅季前进行，并且过了梅季才可以出库，同时温度不能低于2℃，以免影响饮片的质量。